危害分析与关键控制点的英文缩写是
A. HDCCP
B. HNCCP
C. HACCP
D. HECCP
E. HMCCP

正确答案：C。HACCP